公共卫生是研究
A. 疾病发生发展转归过程和专门规律的科学
B. 预防疾病性质、任务、方法和规律的专门科学
C. 疾病在人群的流行和采取有效措施
D. 疾病发生和消除疾病直接或间接因素
E. 对已发生的疾病的治疗和控制的科学

正确答案：B。预防疾病性质、任务、方法和规律的专门科学